为防止职业因素引起的白血病，宜采取下列哪项措施
A. 油漆生产中用锌白代替铅白
B. 制造水银温度计采用真空灌汞法
C. 电镀作业采用无氰电镀
D. 喷漆作业采用无苯稀料
E. 酸洗作业限制酸中砷含量

正确答案：D。喷漆作业采用无苯稀料